防治乙型肝炎的最重要措施是
A. 杜绝乙型肝炎经血液传播
B. 控制家庭内传播
C. 阻断母婴传播
D. 接种乙肝疫苗
E. 注射免疫球蛋白，保护高危人群

正确答案：D。接种乙肝疫苗